邪气亢盛，正气不衰形成的病证是
A. 真虚假实证
B. 真实假虚证
C. 虚证
D. 实证
E. 虚实夹杂证

正确答案：D。实证

解析：本题考察基本病机中邪正盛衰与虚实变化。邪气亢盛，正气不衰属于邪气的致病力强盛而正气抗病能力未衰，正邪相争激烈，属于实证（D对）。真虚假实证和真实假虚证是指在某些特殊情况下，疾病的临床症状可出现与其病机的虚实本质不符的假象（AB错）。虚证指正气不足，是以正气虚损为矛盾主要方面的病机变化（C错）。虚实错杂证，指在疾病过程中，邪盛和正虚同时存在的病机变化（E错）。